哪一种方法不能用于（牙合）创伤的检查
A. 扪诊
B. 视诊
C. 咬蜡片法
D. 咬合纸测试
E. 牙周探诊

正确答案：E。牙周探诊

解析：本题考查（牙合）创伤的检查方法。牙周探诊（E错，为本题正确答案）不能用于（牙合）创伤的检查。牙周探诊是牙周炎诊断中最重要的检查方法，使用专用的牙周探针检查，目的是了解有无牙周袋或附着丧失，并探测其深度和附着水平。（牙合）检查的方法有视诊（B对）、扪诊（A对）、咬合纸法（D对）、蜡片法（C对）、牙线、研究模型、光（牙合）法、（牙合）力计。